对卫生法的条文的含义所作的说明，称为
A. 卫生法的解释
B. 卫生法的形式
C. 卫生法的效力
D. 卫生法的执法
E. 卫生法的守法

正确答案：A。卫生法的解释

解析：卫生法的解释是指对卫生法的条文的含义所作的说明。掌握“卫生法的形式、效力和解释”知识点。